在体内经过两次羟基化产生活性物质的药物是
A. 阿仑膦酸钠
B. 利塞膦酸钠
C. 维生素D₃
D. 阿法骨化醇
E. 骨化三醇

正确答案：C。维生素D₃

解析：本题考查维生素D₃。维生素D₃（C对）为胆骨化醇，本身无活性，须在肝脏和肾脏两次羟基化，代谢为骨化三醇（E错）起作用；阿法骨化醇（D错）经肝脏代谢直接生成骨化三醇；阿仑膦酸钠（A错）主要治疗骨质疏松；利塞膦酸钠（B错）主要用于治疗和预防绝经后妇女的骨质疏松症。